工作地点、在一个工作日内、任何时间均不应超过的有毒物质的浓度是指
A. 生物学接触限值
B. 时间加权平均容许浓度
C. 最高容许浓度
D. 阈限值
E. 短时间接触容许浓度

正确答案：C。最高容许浓度